痛如针刺的病机是
A. 食积
B. 气滞
C. 湿滞
D. 瘀血
E. 火邪窜络

正确答案：D。瘀血